患者，女，65岁。诊断为社区获得性肺炎，伴肾功能不全，肌酐清除率25ml/min，宜选用的无需根据肾功能调整剂量的抗菌药物是
A. 头孢曲松
B. 头孢唑林
C. 头孢噻肟
D. 头孢他啶
E. 头孢吡肟

正确答案：A。头孢曲松

解析：本题考查抗菌药物。宜选用的无需根据肾功能调整剂量的抗菌药物是头孢曲松（A对）。对于重度肾衰竭患者，除了头孢曲松，所有头孢菌素类药物的剂量均需要调整。头孢唑林（B错）主要用于繁殖期杀菌。头孢他啶（D错）属第三代头孢菌素，对革兰阳性菌虽有一定的抗菌毒性，但较第一、二代弱。头孢吡肟（E错）为第四代头孢菌素，对革兰阴性菌和革兰阳性菌有强烈的杀菌作用，对耐药肠杆菌某些菌株敏感。